女性，28岁，风心病10年，心房颤动史3年，长期服用地高辛治疗，停经3个月，诊为早孕，1周来恶心、呕吐、纳差就诊，体检：心脏增大，心率70次/分，律不齐，心尖部第一心音减弱，可闻及3/6级收缩期杂音，向左腋下传导并可及舒张期杂音，胸骨左缘2~4肋间2/6级收缩期杂音，P₂亢进，心电图示心房纤颤、室性早搏。下列哪项表现应与洋地黄无关
A. 恶心，呕吐
B. 右束支传导阻滞
C. 频发室早
D. Ⅲ度房室传导阻滞
E. 黄视

正确答案：B。右束支传导阻滞

解析：育龄期妊娠女性，既往有风心病病史、心房颤动史，长期服用地高辛（为洋地黄制剂）治疗，1周来恶心、呕吐、纳差就诊（洋地黄中毒的胃肠道反应），体检：心脏增大，心率70次/分，律不齐，心尖部第一心音减弱，可闻及3/6级收缩期杂音，向左腋下传导（提示二尖瓣关闭不全）并可及舒张期杂音（提示二尖瓣狭窄），胸骨左缘2～4肋间2/6级收缩期杂音（提示肺动脉瓣狭窄），P₂亢进（提示肺动脉压力增高），心电图示：心房纤颤、室性早搏（洋地黄中毒的特征性表现）。综合该患者的用药史、既往病史、临床症状、体征以及心电图的表现更多考虑为洋地黄中毒。地高辛为常用的洋地黄制剂，洋地黄中毒的主要表现包括：①循环系统：主要表现为各种心律失常，其中室性期前收缩（C对）最常见，还有非阵发性交界区心动过速，房性期前收缩，心房颤动及房室传导阻滞（D对B错）等。②胃肠道表现：恶心、呕吐。③神经系统：视物模糊、黄视（E对）、绿视，定向力障碍、意识障碍等则较少见。